患者，女，60岁，初戴全口义齿，医师检查发现在正中（牙合）接触时，咬合接触点少解决上述问题后，应达到
A. 前后牙均有接触
B. 所有后牙颊舌尖均有接触
C. 最大面积的广泛均匀接触
D. 前牙后牙至少三点接触
E. 功能尖非功能尖均有接触

正确答案：C。最大面积的广泛均匀接触

解析：正中（牙合）平衡：下颌在正中（牙合）位（最广泛接触位或牙尖交错位）时，上下颌人工牙间具有尖窝交错的最大面积的广泛均匀接触，称正中（牙合）平衡。掌握“全口义齿初戴”知识点。